甲状舌管囊肿多见于
A. 婴儿
B. 1～10岁的儿童
C. 青少年
D. 中年人
E. 老年人

正确答案：B。1～10岁的儿童

解析：甲状舌管囊肿多见于1～10岁的儿童，亦可见于成年人。掌握“甲状舌管囊肿及鳃裂囊肿”知识点。